能引起药物性牙龈增生的药物是
A. 苯妥英钠
B. 苯妥英钠+硝苯地平
C. 苯妥英钠+环孢素
D. 硝苯地平+环孢素
E. 苯妥英钠+硝苯地平+环孢素

正确答案：E。苯妥英钠+硝苯地平+环孢素

解析：本题考查药物性牙龈肥大的病因。药物性牙龈肥大是指长期服用某些药物而引起牙龈的纤维性增生和体积增大，常用的为苯妥英钠、环孢素、硝苯地平、维拉帕米（E对），可表现为龈乳头呈球状、结节状，增生的牙龈表面可呈桑葚状或分叶状，一般呈淡粉色，质地坚韧，有弹性，一般不易出血。